小儿生长发育的规律不包括
A. 连续性、非匀速性、阶段性
B. 自下而上
C. 个体差异
D. 两个高峰期
E. 各器官系统发育不平衡

正确答案：B。自下而上

解析：小儿生长发育的规律包括：1.生长发育是连续的、有阶段性的过程（A对），例如，体重和身长在生后第1年，尤其前3个月增加很快，第1年为生后的第一个生长高峰；第2年以后生长速度逐渐减慢，至青春期生长速度又加快，出现第二个生长高峰（D对）。2.各系统、器官生长发育不平衡（E对）。3.生长发育的个体差异（C对）4.生长发育的一般规律 生长发育遵循由上到下（B错，为本题正确答案）、由近到远、由粗到细、由低级到高级、由简单到复杂的规律。